后堤区的作用
A. 基托后缘定位
B. 边缘封闭作用
C. 支持作用
D. 排牙标志
E. 缓冲作用

正确答案：B。边缘封闭作用

解析：边缘封闭区：是义齿边缘接触的软组织部分，包括上下颌口腔前庭沟底、唇颊舌系带附着部、下颌舌侧口底黏膜反折处、上颌后堤区和下颌磨牙后垫。此区有大量疏松结缔组织，软组织活动度大，不能承受咀嚼压力。但是这些组织可以与义齿边缘紧密贴合，防止空气进入基托与组织之间，产生良好的边缘封闭作用，从而形成负压和两者之间的吸附力，保证义齿固位。掌握“无牙颌的解剖标志及功能分区”知识点。